肺动脉高压早期的X线表现是
A. 双肺纹理增多
B. 双肺透亮度增加
C. 右下肺主动脉干增宽
D. 右心房肥大
E. 右心室肥厚、扩张

正确答案：C。右下肺主动脉干增宽

解析：肺动脉高压早期的X线表现为右下肺动脉干扩张，其横径＞15mm（C对）；横径与气管横径的比值＞1.07；肺动脉段明显突出，或其高度＞3mm；右心室肥大征。双肺纹理增多（A错）、双肺透亮度增加（B错）、右心房肥大（D错）、右心室肥厚、扩张（E错）均未出现在肺动脉高压早期的X线表现里。